对于开放性肺结核其分泌物有扩散感染能力者应选用
A. 经鼻盲探插管法
B. 经鼻腔明视插管法
C. 经口盲探气管内插管法
D. 清醒气管内插管法
E. 双腔支气管导管DLT插管术

正确答案：E。双腔支气管导管DLT插管术

解析：双腔支气管导管插管术的适应证：1.“湿肺”病人全麻手术，如肺脓肿、支气管扩张等。2.开放性肺结核其分泌物有扩散感染能力者。3.支气管胸膜瘘、外伤性支气管断裂者，以健侧肺维持有效通气量和麻醉深度。4.近期有大咯血者。所以对于开放性肺结核其分泌物有扩散感染能力者应选用双腔支气管导管DLT插管术（E对）。经鼻盲探插管法的适应证：本法主要用于张口确实困难，喉镜难以置人口腔并需呼吸道管理的病人（A错）。经鼻腔明视插管法的适应证：1.口腔、颌面、咽腔手术。2.经口插管有困难者，如张口困难、门齿松动并必须避免损伤者（B错）。经口盲探气管内插管法的适应证：1.部分张口困难但能容下导管和牙垫者。2.呼吸道部分梗阻。3.颈部强直、颈椎骨折脱白等颈部活动受限者。4.颈前瘢痕挛缩严重影响抬头活动者。5.喉结过高、颈部粗短、下颌退缩等特殊病人（C错）。清醒气管内插管法的适应证：1.估计快速诱导插管有一定困难者。2.消化道梗阻或饱食者，以避免麻醉引起胃反流而误吸3.不能耐受较深麻醉，但必须要控制呼吸或人工呼吸者。4.颅脑、开胸等针麻手术（D错）。